要求在15分钟内崩解或溶化的片剂是
A. 普通片
B. 舌下片
C. 糖衣片
D. 可溶片
E. 肠溶衣片

正确答案：A。普通片

解析：本题考查片剂的崩解时限。普通片剂（A对）的崩解时限是15分钟；舌下片（B错）崩解时限为5分钟；糖衣片为薄膜衣片（C错），崩解时限为30分钟；可溶片（D错）崩解时限为3分钟；肠溶衣片（E错）要求在盐酸溶液中2小时内不得有裂缝、崩解或软化现象，在pH6.8磷酸盐缓冲液中1小时内全部溶解并通过筛网等。